精的本始含义是指
A. 脏腑之精
B. 基本物质
C. 生殖之精
D. 水谷之精
E. 血液津液

正确答案：B。基本物质

解析：精有广义和狭义之分，广义之精包括气、血、津液等人体一切精微物质，狭义之精专指生殖之精。《素问·金匮真言论》：“夫精者，身之本也”（B对）；脏腑之精指后天之精（A错）；生殖之精是狭义之精（C错）；水谷之精来源于饮食水谷，禀受于后天，故又称后天之精（D错）；精是指精、血、津、液的统称（E错）。